职业卫生知识与防护技能教育的主要内容是
A. 消除职业精神紧张与改变不良作业方式
B. 改善劳动环境
C. 治理职业有害因素
D. 日常个人卫生习惯教育
E. 营养与合理膳食教育

正确答案：A。消除职业精神紧张与改变不良作业方式